广泛搜寻可能的危险因子的分析性研究是
A. 描述性研究
B. 检验性病例对照研究
C. 探索性病例对照研究
D. 历史性队列研究
E. 双向性队列研究

正确答案：C。探索性病例对照研究

解析：本题考查病例对照研究的优点。探索性病例对照研究（C对ABDE错）是可以广泛搜寻可能的危险因子的分析性研究。